健康女性HPV持续感染可引起宫颈癌前期病变，进一步发展可形成宫颈癌，对于宫颈癌患者继续跟踪随访，观察其转归状况和规律，此流行病学应用属于
A. 健康促进
B. 疾病监测
C. 疾病病因的研究
D. 了解疾病的自然史
E. 疾病预防

正确答案：D。了解疾病的自然史

解析：本题考查流行病学的应用。流行病学的应用包括疾病预防和健康促进、疾病的监测、疾病的自然史、疾病病因和危险因素的研究以及疾病防治的效果评价。健康女性HPV持续感染可引起宫颈癌前期病变，进一步发展可形成宫颈癌，对于宫颈癌患者继续跟踪随访，观察其转归状况和规律，此流行病学应用属于了解疾病的自然史（D对ABCE错）。